某女，48岁。经血量多，非时而下，淋沥不净，血色紫暗有块，小腹疼痛，舌紫暗，脉弦涩有力。中医辨证是
A. 气血两虚
B. 脾不统血
C. 肝肾不足
D. 瘀血阻络
E. 冲任不固

正确答案：D。瘀血阻络

解析：本题考查的是崩漏的辨证论治。经血量多，非时而下，淋沥不净，血色紫暗有块，小腹疼痛，舌紫暗，脉弦涩有力。中医辨证是瘀血阻络（D对）。崩漏是月经的周期、经期、经量发生严重失常的病证，经血非时暴下不止或不尽，前者谓之崩中，后者谓之漏下。崩与漏出血情况虽不同，然二者常相互转化，交替出现，且其病因病机基本相同，故概称崩漏。西医学中的无排卵性功能性子宫出血，可参照本证进行辨证治疗。（一）气血两虚（A错）证：【症状】出血量多或淋沥不尽，血色淡薄，面色无华，气短懒言，食欲不振，便溏。舌质淡，苔薄白湿润，脉细弱。（二）脾不统血（B错）证：【症状】出血量多，日久而止，气短神疲，面色㿠白，或面浮肢肿，手足不温，或饮食不佳，大便溏。舌质淡，苔薄白，脉弱或沉弱。（三）肝肾不足（C错）证：【症状】月经非时而下，或月经先期，经期延长，经血暗红，量少而淋沥不畅，咽干颧红，心烦潮热，腰膝酸软。舌红苔少或光剥苔，脉沉细无力。（四）瘀血阻络证：【症状】经血非时而下，量时多时少，时出时止，或淋沥不断，或停闭数月又突然崩中，继之漏下，经色暗有血块；舌质紫暗或尖边有瘀点，脉弦细或涩。冲任不固（E错）可致崩漏、带下、阴挺、胎动不安等。